关于肛管正确的是
A. 为直肠位于盆膈以下的部位
B. 位于肛提肌附着处以下
C. 肛管约2.5~4.0cm长
D. 其内面有6~10条纵行肛柱
E. 以上都正确

正确答案：E。以上都正确

解析：肛管为直肠穿过盆膈以下的部位(A对)，其位于肛提肌附着处以下(B对)，长约2.5～4cm(C对)，内面有6～10条纵行黏膜皱襞为肛柱(D对，故E为本题正确答案)。